管理舌后1/3的感觉
A. 舌咽神经
B. 迷走神经
C. 三叉神经
D. 舌下神经
E. 面神经

正确答案：A。舌咽神经

解析：舌咽神经（A对）发出特殊内脏纤维，支配舌后1/3的感觉。迷走神经（B错）主要分布到颈部、胸腔脏器和腹腔大部分脏器。三叉神经（C错）主要传导咀嚼肌和眼外肌的本体感觉以及面部皮肤、眼及眶内、口腔、鼻腔、鼻旁窦的黏膜、牙齿、脑膜等，传导痛、温、触等浅感觉。舌下神经主（D错）要支配舌内肌和大部分舌外肌。面神经（E对）主要支配舌前2/3的感觉。